不是混悬剂稳定剂的是
A. 助悬剂
B. 润湿剂
C. 增溶剂
D. 絮凝剂
E. 反絮凝剂

正确答案：C。增溶剂

解析：本题考查混悬剂。增溶剂（C错，为本题正确答案）不属于混悬剂的稳定剂。稳定剂包括润湿剂（B对）、助悬剂（A对）、絮凝剂（D对）与反絮凝剂（E对）。